一正常产妇住院，顺利娩出一女婴，新生儿正常，医院积极采取以下促进母乳喂养的成功措施，但是不包括
A. 鼓励按时哺乳
B. 帮助母亲在分娩后半小时内开始母乳喂养
C. 不给新生儿母乳以外的任何饮料和食品
D. 不给母乳喂养的孩子使用人工乳头或安慰物
E. 24小时母婴同室

正确答案：A。鼓励按时哺乳

解析：本题考查促进母乳喂养的成功措施。鼓励按需哺乳（E错，为本题正确答案），根据婴儿情况进行哺乳。世界卫生组织及联合国儿童基金会共同制定了十点措施以保护、促进和支持母乳喂养。要求：①有书面的母乳喂养规定，并常规地传达到全体卫生保健人员；②对全体卫生保健人员实施规定的技术培训；③将母乳喂养的好处及处理方法告诉所有孕妇；④帮助母亲在分娩后半小时内开始母乳喂养（B对）；⑤指导母亲母乳喂养，以及当与孩子分离时如何保持泌乳；⑥不给新生儿母乳以外的任何饮料和食品（C对），除非有医疗适应证；⑦实施24小时母婴同室（E对）；⑧鼓励按需哺乳；⑨不给母乳喂养的孩子使用人工乳头或安慰物（D对）；⑩建立母乳喂养支持组织，并将出院的母亲转到这些组织。